来源于牙源性上皮剩余的颌骨中央性癌
A. 舌癌
B. 骨肉瘤
C. 口腔癌
D. 牙龈癌
E. 原发性骨内鳞状细胞癌

正确答案：E。原发性骨内鳞状细胞癌

解析：本题考查原发性骨内鳞状细胞癌。来源于牙源性上皮剩余的颌骨中央性癌的是原发性骨内鳞状细胞癌（E对）。原发性骨内鳞状细胞癌：是来源于牙源性上皮剩余的颌骨中央性癌。颌骨为全身骨骼系统内唯一能发生原发性上皮癌的骨骼。